患者暴饮过食之后，突然昏厥，气息窒塞，脘腹胀满，舌苔厚腻，脉滑实。经探吐治疗后，应首选
A. 藿香正气散
B. 藿朴夏苓汤
C. 枳实导滞丸
D. 神术散合保和丸
E. 越鞠丸

正确答案：D。神术散合保和丸

解析：患者暴饮暴食之后，食填中脘，胃气不降，气逆而上，清窍闭塞，故见突然昏厥，气息窒塞；食浊郁于胸中，肺气不利，食滞内停，气与食并，故脘腹胀满；舌苔厚腻，脉滑实，为食滞不消，浊气不降之侯；治疗应理气消食，开窍醒神，方药选用神术散合保和丸加减（D对）。藿香正气散（A错）可以解表化湿，理气和中，用于治疗外感风寒，内伤湿滞证。藿朴夏苓汤（B错）可以解表化湿，治疗湿温初起夹表证。枳实导滞丸（C错）可以消食导滞，清热祛湿，用于治疗湿热食积证。越鞠丸（E错）可以行气解郁，用于治疗气、血、痰、火、湿、食六郁证。